在水或规定的释放介质中缓慢地恒速或接近于恒速释放药物的颗粒剂是
A. 混悬颗粒
B. 泡腾颗粒
C. 肠溶颗粒
D. 缓释颗粒
E. 控释颗粒

正确答案：E。控释颗粒

解析：本题考查颗粒剂。控释颗粒（E对）能够在规定的释放介质中缓慢地恒速或接近恒速释放药物；混悬颗粒（A错）指难溶性药物与辅料制成一定粒度的干燥颗粒；泡腾颗粒（B错）是以碳酸氢钠和有机酸为主要辅料制备的颗粒剂，能够在水中呈现出泡腾状；肠溶颗粒（C错）系指采用肠溶材料包裹颗粒，其耐胃酸；缓释制颗粒（D错）系指在规定的释放介质中缓慢非恒速地释放药物的颗粒剂。